缺铁性贫血患者因组织缺铁而发生的临床表现不包括
A. 口腔炎、舌炎
B. 匙状甲
C. 吞咽困难
D. 头晕、乏力
E. 皮肤干燥、皱缩

正确答案：D。头晕、乏力

解析：缺铁性贫血的临床表现分为缺铁原发病表现、贫血表现和组织缺铁表现。组织缺铁表现有精神行为异常；体力、耐力下降；易感染 ；口腔炎、舌炎（A对）、吞咽困难（C对）；毛发干枯、脱落；皮肤干燥、皱缩（E对）；指（趾）甲缺乏光泽、脆薄易裂重者呈匙状甲（B对）。头晕、乏力（D错，为本题正确答案）属于贫血表现，并不是组织缺铁表现。